下列病因模型不能指示病因的方向的是
A. 轮状模型
B. 微生物说
C. 瘴气说
D. 健康决定因素的生态模型
E. 病因网络

正确答案：E。病因网络

解析：本题考查病因模型的作用。在病因模型中，轮状模型（A对）、微生物说（B对）、瘴气说（C对）、健康决定因素的生态模型（D对）可用来指示病因的方向。而病因网络（E错，为本题正确答案）不能指示病因的方向。